腘淋巴结的输出管注入
A. 腹股沟深淋巴结
B. 腹股沟浅淋巴结
C. 髂外淋巴结
D. 腰淋巴结
E. 髂内淋巴结

正确答案：A。腹股沟深淋巴结

解析：腹股沟深淋巴结（A对）为腘淋巴结的输出管注入部位，包括收纳足外侧缘和小腿后外侧部的浅淋巴管以及足和小腿的深淋巴管。